根据乳腺癌在不同部位发生率的多少，扪诊时最需要注意的是乳腺的
A. 内上象限
B. 内下象限
C. 外下象限
D. 外上象限
E. 中央区

正确答案：D。外上象限

解析：50%以上的乳腺癌位于乳腺外上象限，因此，扪诊时最需要注意的是乳腺的外上象限（D对）。